男，47岁。交通事故导致右肘关节上方被车轮压伤2小时。剧痛、出血较多。查体：P96次/分，BP88/60mmHg，神志清楚，右肘窝伤口已加压包扎，敷料鲜血渗透，桡动脉搏动消失。若伤口不能及时处理，每次持续止血的时间至多是
A. 1.5小时
B. 2.5小时
C. 2小时
D. 0.5小时
E. 1小时

正确答案：E。1小时

解析：患者桡动脉搏动消失，应考虑合并上肢大动脉损伤。患者右肘窝伤口已加压包扎，但敷料仍被鲜血渗透，说明包扎止血效果不好，还存在活动性出血。因此，患者送入医院后，首先应进行的处理是用止血带绕扎上臂止血。止血带止血一般用于四肢伤大出血，且加压包扎无法止血的情况。而使用止血带时应注意以下事项：①不能缚扎过紧，能止住出血即可；②使用止血带的时间最多是1小时（E对ABCD错），应每隔1小时放松1～2分钟，且使用时间不要超过4小时；③上止血带的伤员必须有显著标志，并注明启用时间；④松解止血带之前，应先输液或输血，补充血容量，准备好止血用器材，然后再松止血带；⑤因止血带使用时间过长，远端肢体已发生坏死者，应在原止血带的近端加上新止血带，然后再行截肢术。